护牙托是一种弹性片状减震装置，其主要成分是
A. 甲基丙烯酸甲酯
B. 氯化亚铁
C. 硫酸铜
D. 多聚甲醛
E. 乙烯-醋酸乙烯酯共聚物

正确答案：E。乙烯-醋酸乙烯酯共聚物

解析：护牙托是一种弹性片状减震装置，多用乙烯-醋酸乙烯酯共聚物（EVA）制作而成。掌握“牙外伤的预防”知识点。